患者，男，40岁。患慢性淋病，小便短涩，淋漓不尽，腰酸腿软，五心烦热，食少纳差，舌红，苔少，脉细数。其证候是
A. 湿热毒蕴
B. 脾肾阳虚
C. 阴虚毒恋
D. 脾虚肝旺
E. 阴虚火旺

正确答案：C。阴虚毒恋

解析：该患者患慢性淋病，久病体虚，以致正气亏虚，邪毒不出，下注膀胱，故小便短涩，淋漓不尽；肾阴亏虚，虚热内生，故腰酸腿软，五心烦热；舌红，苔少，脉细数均为阴虚火旺之象，故辨为阴虚毒恋证（C对）（ABDE错）。